完全固定桥又称
A. 半固定桥
B. 单端固定桥
C. 双端固定桥
D. 复合固定桥
E. 粘接固定桥

正确答案：C。双端固定桥

解析：双端固定桥：又称完全固定桥。固定桥两端固位体与桥体之间的连接形式为固定连接，当固位体粘固于基牙后，基牙、固位体、桥体则连接成一个不动的整体，从而组成新的咀嚼单位。掌握“固定桥的设计”知识点。